《药品生产质量管理规范附录》规定，使用的传输设备不得穿越较低级别区域的洁净区级别应为
A. 100级
B. 1000级
C. 10000级
D. 100000级
E. 300000级

正确答案：C。10000级